对厌氧菌有广谱抗菌作用的抗生素是
A. 克林霉素
B. 甲硝唑
C. 多黏菌素
D. 利福平
E. 罗红霉素

正确答案：B。甲硝唑

解析：本题考查甲硝唑。对厌氧菌有广谱抗菌作用的抗生素是甲硝唑（B对）。克林霉素（A错）用于革兰阳性菌。多黏菌素（C错）对革兰阴性杆菌有效。利福平（D错）对厌氧菌作用弱。罗红霉素（E错）对厌氧消化球菌有作用，但对其它厌氧菌作用弱。